避免儿童青少年“移情”咨询者，遵循了心理咨询的哪条原则
A. 保密的有原则
B. 限时的原则
C. 自愿的原则
D. 情感自限的原则
E. 延期决定的原则

正确答案：D。情感自限的原则